生产、销售劣药，对人体健康造成严重危害且后果特别严重的，处以
A. 十年以下有期徒刑，并处销售金额百分之三十以上二倍以下罚金
B. 十年以下有期徒刑，并处销售金额百分之五十以上二倍以下罚金
C. 十年以上二十年以下有期徒刑，并处销售金额百分之三十以上二倍以下罚金
D. 十年以上二十年以下有期徒刑，并处销售金额百分之五十以上二倍以下罚金
E. 十年以上有期徒刑或无期徒刑，并处销售金额百分之五十以上二倍以下罚金

正确答案：E。十年以上有期徒刑或无期徒刑，并处销售金额百分之五十以上二倍以下罚金

解析：本题考查生产、销售、使用劣药的刑事责任。生产、销售劣药，对人体健康造成危害，后果特别严重的十年以上有期徒刑或无期徒刑，并处销售金额百分之五十以上二倍以下罚金（E对）。根据《刑法》第一百四十二条规定，生产、销售劣药，对人体健康造成严重危害的，处三年以上十年以下有期徒刑，并处罚金；后果特别严重的，处十年以上有期徒刑或者无期徒刑，并处罚金或者没收财产。